关于立克次体，错误的是
A. 以二分裂方式繁殖
B. 多数为人畜共患病的病原体
C. 与变形杆菌的某些菌株有共同抗原成分
D. 可在无生命培养基中生长
E. 与节肢动物关系密切

正确答案：D。可在无生命培养基中生长

解析：本题考查立克次体的特点。关于立克次体错误的是可在无生命培养基中生长（D错，为本题的正确答案）。立克次体是以二分裂方式繁殖（A对），生长速度缓慢；多数是人兽共患病的病原体（B对），在人类引起发热出疹性疾病；斑疹伤寒群立克次体和恙虫病东方体与变形杆菌的某些菌株有共同抗原成分（C对），故可用这些菌株的菌体抗原（如OXI9、OX2、OXK）代替立克次体抗原检测患者血清中相应抗体，此交叉凝集试验称外斐反应，可辅助诊断立克次体病；由于酶系统不完善，缺乏细胞器，故专性细胞内寄生，故不能在无生命培养基中生长；以节肢动物作为传播媒介或储存宿主，与节肢动物关系密切（E对）。